男，48岁。因意识不清，话多零乱，看见鬼怪，觉得有人要害自己3天来诊。查体：意识模糊，双手粗大震颤，双下肢水肿，既往体健，有长期饮酒史。该患者目前最可能的症状
A. 病理性醉酒
B. 单纯性醉酒
C. 震颤谵妄
D. 酒精中毒性幻觉妄想
E. Wernicke脑病

正确答案：C。震颤谵妄

解析：该患者有长期饮酒史，看见鬼怪（视幻觉），觉得有人要害自己（妄想），意识模糊，双手粗大震颤，双下肢水肿，既往体健，故最可能的症状是震颤谵妄（C对）。酒精性幻觉的患者意识清晰，为慢性酒精依赖患者所出现的持久的精神病性障碍，也可能是酒依赖者突然停饮后（一般在48小时后）出现器质性幻觉，与本例不符（D错）。Wernicke脑病是由于维生素B1缺乏所致，表现为眼球震颤、眼球不能外展，与本例不符（E错）。